医学伦理学最古老，最有生命力的医德范畴是
A. 医疗保密
B. 医疗公正
C. 医疗权利
D. 医疗荣誉
E. 医疗义务

正确答案：A。医疗保密

解析：医疗保密（A对）在医疗实践中有特殊重要的作用，它是医学伦理学中最古老、也是最有生命力的医德范畴。从希波克拉底誓言到日内瓦宣言、病人权利法案等，保守医疗秘密一直是非常重要的道德要求，因为病人是生活在一定社会环境中的、有思想和心理活动的人。